得神的面色特征是
A. 面色荣润，含蓄不露
B. 面色少华，黯淡不容
C. 面色无华，晦暗暴露
D. 面似有华，泛红如妆
E. 面色无华，青如草兹

正确答案：A。面色荣润，含蓄不露

解析：人体面部皮肤的色泽亦是神气外现的重要征象。心主藏神，其华在面，故面部皮肤的颜色及光泽的变化，能较准确地反映心神健旺与否，皮肤荣润，红光满面，含蓄不露，为神气充盛之象（A对）；面色少华，黯淡不容是少神的表现（B错）；面色无华，晦暗暴露是失神的表现（C错）；面似有华，泛红如妆是假神的表现（D错）；面色无华，青如草兹是病人病势将危得面色表现（E错）。